治疗急性疱疹性龈口炎首选全身药物
A. 口炎冲剂
B. 无环鸟苷
C. B族维生素
D. 皮质类固醇
E. 广谱抗生素

正确答案：B。无环鸟苷

解析：本题考查治疗急性疱疹性龈口炎的首选全身药物。急性疱疹性龈口炎的致病菌为单纯疱疹病毒，目前认为核苷类药物是抗单纯疱疹病毒最有效的药物。主要有阿昔洛韦（又叫无环鸟苷）（B对）、伐昔洛韦、泛昔洛韦和更昔洛韦。口炎冲剂（A错）是一种口服冲剂，属于中医中药治疗，不是首选全身药物。进食困难者可静脉输液，补充B族维生素（C错），不属于首选全身药物。急性疱疹性龈口炎局部或全身禁用皮质类固醇（D错）药物，以免病毒扩散产生严重后果。为预防继发感染，可根据病情加用抗生素（E错），但不是首选全身药物。